肿瘤的特异性免疫治疗是应用
A. 麻疹疫苗
B. 短棒状杆苗疫苗
C. 接种自身疫苗
D. α-干扰素
E. 白细胞介素-2

正确答案：C。接种自身疫苗

解析：短棒状杆苗疫苗（B错）、α-干扰素（D错）、白细胞介素-2（E错）、麻疹疫苗（A错）为免疫调节剂，非特异性的增强宿主免疫功能。接种自身疫苗（C对）是肿瘤的特异性免疫治疗，使宿主免疫系统产生针对肿瘤抗原的抗肿瘤免疫应答。